尺神经沟位于
A. 肱骨内上髁后方
B. 肱骨外上髁后方
C. 尺骨下端后方
D. 尺骨上端后方
E. 无

正确答案：A。肱骨内上髁后方

解析：尺神经沟位于肱骨内上髁后方（A对）。尺骨上端前面有滑车切迹，与肱骨滑车相关节（D错），下端为尺骨头，其前、外、后有环状关节面与桡骨的尺切迹相关节（C错）。